急性毒性评价的常用参数有
A. LD₅₀
B. Limac
C. Zac
D. LOAEL
E. 剂量-反应曲线的斜率

正确答案：A。LD₅₀